属于气行失常的病机变化有
A. 气滞
B. 气逆
C. 气陷
D. 气脱
E. 气虚

正确答案：A、B、C、D。气滞；气逆；气陷；气脱

解析：本题考查的是气失调。属于气行失常的病机变化有气滞（A对）、气逆（B对）、气陷（C对）和气脱（D对）。气失调，主要包括气虚和气机失调两方面的病机变化。（1）气虚（E错）：气虚，是指元气耗损，功能失调，脏腑功能衰退，抗病能力下降的病机变化。主要由于先天禀赋不足，或后天失养，或肺脾肾的功能失调而致气的生成不足；也可因劳倦内伤，久病不复等而致。气虚有多种情况，例如，脏腑气虚，包括心气虚、脾气虚、肺气虚等；以及元气不足、宗气不足、营气不足、卫气不足等。气虚，则推动、营养、防御等功能减弱。若某一脏腑之气不足，则表现为该脏腑功能减弱的虚证。例如，心气不足，可致推动血液运行的功能减弱；卫气不足，则易为外邪所侵袭。（2）气机失调：气机失调，是指气的升降出入运行失常，而引起的气滞、气逆、气陷、气闭和气脱等病机变化。气运行于经络之中，卫气运行于脉外，贵乎流通畅达。若因外感、内伤，或痰食中阻，即可阻碍气之运行，导致气的运行失常。气行失常，可涉及五脏六腑、表里内外、四肢九窍等各方面的多种病变。一般概括为：气滞、气逆、气陷、气闭和气脱等。病变部位不同，各有不同的特征。经络之气郁滞或逆乱，则相应部位可出现疼痛。内脏气滞或逆乱，则其功能将发生异常。例如，脾胃气滞，则不能受纳运化，可见脘腹胀满、食欲不振等；感受寒邪，腠理闭塞，卫气郁滞于表，则为发热无汗、身体疼痛等。